女，40岁，接触性阴道流血，妇科检查宫颈呈糜烂样改变，病理活检可见异型细胞局限宫颈上皮的下1/3，黏膜下炎细胞浸润，最可能的诊断为
A. 微小浸润癌
B. 低级别鳞状上皮内瘤变
C. 宫颈高鳞状细胞癌
D. 慢性宫颈炎伴鳞状上皮化生
E. 慢性弥漫性宫颈炎

正确答案：B。低级别鳞状上皮内瘤变

解析：女，40岁，接触性阴道流血（宫颈癌的表现），妇科检查宫颈呈糜烂样改变（宫颈癌的体征），病理活检可见异型细胞局限宫颈上皮的下1/3，黏膜下炎细胞浸润，结合患者的表现和查体，最可能的诊断为宫颈低鳞状细胞癌（B对ACDE错）。